某患儿，5岁，体弱多病，近日口臭，便秘，家长希望用中药调理。请根据就诊情况选择用药。近一段时间调理，患儿症状有所改善，但仍觉神疲乏力，易感冒，多汗，舌质淡，此时宜选用的中药是
A. 黄芪、太子参
B. 陈皮、茯苓
C. 藿香、薏苡仁
D. 白扁豆、稻芽
E. 白芍、稻芽

正确答案：A。黄芪、太子参

解析：本题考查的是婴幼儿患者应用中药的注意事项。患儿，5岁，体弱多病，近日口臭，便秘，家长希望用中药调理。请根据就诊情况选择用药。近一段时间调理，患儿症状有所改善，但仍觉神疲乏力，易感冒，多汗，舌质淡，此时宜选用的中药是黄芪、太子参（A对）。婴幼儿患者应用中药的注意事项：婴幼儿服用中药应有讲究。中医认为“虚者补之”。这就是说，滋补药的对象应该是有虚证的小儿。随意甚至滥用中药滋补剂，如人参、人参蜂王浆、冬虫草精、北芪精等，不但达不到效果，还可能适得其反。例如小儿感冒后容易食欲减退，若此时舌苔厚腻、口有异味、大便秘结，说明体内湿热重，绝不能给予滋补药。又如生长发育旺盛的小儿，若过多服用含有激素的食品或补品，可引发性早熟，导致男孩子口唇边汗毛变粗、变长，阴茎变粗、易勃起；女孩子八九岁乳房就开始增大，阴蒂增大，乃至阴道流血等。对于体虚夹湿热，而有口臭、便秘、舌苔黄腻的患儿应先用清热除湿的广藿香、黄芩、黄连、薏苡仁（B错）、陈皮等，使热清湿化，然后再服调补中药；如平时易感冒、多汗，属于气虚的患儿，可服用补气固表的黄芪、太子参、白术等；如消瘦、面色萎黄、厌食、大便溏稀，属于脾虚，可选用健脾和胃消食的山药、茯苓、白术、白扁豆、稻芽等；若面色苍白、神疲乏力、夜寐不安、舌质淡，属于气血两虚的小儿，可给予益气养血的黄芪、党参（C错）、当归、黄精、首乌、大枣等。有些小儿生长发育迟缓、尿频、面色苍白、舌胖，属于肾虚，宜用补肾的补骨脂、菟丝子、肉苁蓉（D错）、熟地（E错）等。总之，健康小儿不必进补，尤其婴幼儿更不宜乱进补。